生殖健康内涵不正确的是
A. 人们能够进行负责、满意和安全的性生活，而不担心传染疾病和意外妊娠
B. 人们能够生育，并有权决定是否、何时生育和生育间隔
C. 妇女能够安全地通过妊娠和分娩，妊娠结局是成功的，婴儿存活并健康成长
D. 夫妇能够知情选择和获得安全、有效和可接受的节育方法
E. 是指在生命各阶段没有生殖系统疾病

正确答案：E。是指在生命各阶段没有生殖系统疾病

解析：本题考查生殖健康内涵。生殖健康是指人类在生殖系统、生殖功能和生殖过程的各个方面处于健康和良好的状态（E错，为本题正确答案）。生殖健康内涵：人们能够进行负责、满意和安全的性生活，而不担心传染疾病和意外妊娠（A对）；人们能够生育，并有权决定是否、何时生育和生育间隔（B对）；妇女能够安全地通过妊娠和分娩，妊娠结局是成功的，婴儿存活并健康成长（C对）；夫妇能够知情选择和获得安全、有效和可接受的节育方法（D对）。